均以节肢动物为媒介的组合，哪项错误
A. 乙型脑炎病毒，登革病毒
B. 乙型脑炎病毒，麻疹病毒
C. 登革病毒，斑疹伤寒立克次体
D. 登革病毒，恙虫病立克次体
E. 乙型脑炎病毒，Q热柯克斯体

正确答案：B。乙型脑炎病毒，麻疹病毒